在影响动脉血压的诸因素中，搏出量增多而其他因素不变时，脉压增大的主要原因是
A. 收缩压、舒张压均降低
B. 收缩压、舒张压均升高
C. 收缩压升高，舒张压降低
D. 收缩压降低，舒张压变化不大
E. 收缩压升高，舒张压变化不大

正确答案：E。收缩压升高，舒张压变化不大